木脂素的基本结构为联苯环辛烯型的是
A. 五味子
B. 厚朴
C. 二者皆是
D. 二者皆不是

正确答案：A。五味子

解析：本题考查的是五味子的化学成分。木脂素的基本结构为联苯环辛烯型的是五味子（A对）。五味子中含木脂素较多，约为5%，近年来从其果实中分得了一系列联苯环辛烯型木质素。《中国药典》采用高效液相色谱法测定药材中五味子醇甲的含量，要求不得少于0.40%。厚朴（B错）中主要化学成分为木脂素类化合物，包括厚朴酚以及和厚朴酚等，《中国药典》采用高效液相色谱法测定药材中厚朴酚与和厚朴酚含量，两者总含量不得少于2.0%。